宫内妊娠时孕妇血清绒毛膜促性腺激素高峰出现在
A. 5～7周
B. 8～10周
C. 11～13周
D. 14～16周
E. 17～19周

正确答案：B。8～10周

解析：HCG妊娠期间分泌量达高峰的时间是妊娠8～10周（B对），持续约19日迅速下降，直至妊娠前。